男，30岁，餐后突发右上腹及剑突下痛，放射到右肩及后背部，二小时后疼痛剧烈，伴恶心，并吐出所进食物，仍不缓解，急诊就医。数年“胃病”史及胆石症历史，间有胆绞痛发作，查体：痛苦病容，体温37.2℃，呼吸28次/分，浅快，律齐。全腹胀，上腹肌紧张，压痛反跳痛（+）。移动性浊音（±），白细胞12×10⁹/L，血红蛋白125g/L，尿淀粉酶400U（温氏法正常值32μ）。排除该项诊断（急性肠胃炎）的最主要根据是
A. 患者有持续腹痛
B. 尿淀粉酶轻度升高
C. 上腹部存在肌紧张反跳痛
D. 患者体温轻度高
E. 患者有腹胀

正确答案：C。上腹部存在肌紧张反跳痛

解析：急性胃肠炎时，炎症一般局限于黏膜层和黏膜下层，较少累及浆膜层和壁腹膜，因此不会出现上腹部压痛、反跳痛和腹肌紧张（C对）。腹痛（A错）、腹胀（E错）等症状是大多数消化系统疾病的共同表现，发热（D错）为感染性疾病的一般表现，均不具有特异性。尿淀粉酶明显增高可作为胰腺炎的诊断依据，尿淀粉酶轻度增高可见于胃十二指肠穿孔、肠梗阻、急性胆囊炎等，而急性胃肠炎时尿淀粉酶多正常（B错）。